伤寒杆菌的主要致病因素
A. 外毒素
B. 伤寒内毒素
C. 细菌的侵袭力
D. 抗原
E. 肠毒素

正确答案：B。伤寒内毒素

解析：伤寒杆菌裂解可释放伤寒内毒素（B对），在本病的发病过程中起重要作用。伤寒杆菌随血液循环进入肝、脾、胆囊、骨髓、肾等器官组织中大量繁殖播散，释放内毒素，患者出现发热、全身不适等症状；伤寒杆菌不产生外毒素（A错）；细菌的侵袭力（C错）不属于致病因素；伤寒杆菌有脂多糖菌体抗原、鞭毛抗原和多糖毒力抗原（D错），可刺激机体产生抗体；伤寒杆菌不释放肠毒素（E错）。